男性，60岁。突然呼吸困难伴咳嗽2小时，两肺闻及哮鸣音，心率126次/分，杂音听不清。应给子哪项治疗
A. 肾上腺素
B. 氨茶碱
C. 吗啡
D. 异丙肾上腺素
E. 哌替啶

正确答案：B。氨茶碱